无感染高危因素的医院内获得性肺炎患者，最常见的致病菌是
A. 白色念珠菌
B. 肺炎链球菌
C. 大肠杆菌
D. 金黄色葡萄球菌
E. 溶血链球菌

正确答案：B。肺炎链球菌

解析：医院获得性肺炎最常见的病原菌：①无感染高危因素的患者是肺炎链球菌；②有感染高危因素的患者是金黄色葡萄球菌。掌握“肺炎”知识点。